转移发生较迟且少见的口腔癌是
A. 唇癌
B. 舌癌
C. 口底癌
D. 颊癌
E. 牙龈癌

正确答案：A。唇癌

解析：本题考查口腔癌。转移发生较迟且少见的口腔癌是唇癌（A对）。口腔癌狭义指口腔鳞状细胞癌，是发生于舌、口底、腭、牙龈、颊和牙槽黏膜的一种癌症，是世界上10种最常见的癌症之一。在我国以舌癌、颊黏膜癌、牙龈癌、腭癌最为常见。尤其是舌癌（B错），近年有明显上升的趋势，占口腔癌的41.8%；其次是颊黏膜癌（D错），占口腔癌的30.2%；牙龈癌（E错）近年有下降趋势，占口腔癌的2.5%；其他如腭癌和口底癌（C错）也占一定的比例。